易发生DIC的急性白血病类型是
A. 急性淋巴细胞白血病
B. 急性淋巴细胞白血病部分分化型
C. 急性早幼粒细胞白血病
D. 急性单核细胞白血病
E. 红白血病

正确答案：C。急性早幼粒细胞白血病

解析：易发生DIC的急性白血病类型是急性早幼粒细胞白血病（C对），患者早幼粒细胞中含有大量的嗜天青颗粒，颗粒释放（含大量组织凝血活酶的促凝物质）入血易引起凝血障碍导致DIC（弥散性血管内凝血）。急性淋巴细胞白血病（A错）、急性淋巴细胞白血病部分分化型（B错）、急性单核细胞白血病（D错）、红白血病（E错）细胞内不含颗粒，不易引起DIC。